对盐酸麻黄碱描述错误的是
A. 可通过血脑屏障
B. 属易制毒化学品
C. 构型为（1S，2S）
D. 在水中易溶解
E. 构型为赤藓糖型

正确答案：C。构型为（1S，2S）